女，36岁，反复腹泻2年，间有脓血便，粪培养阴性，多种抗生素治疗无效，为明确诊断，首选的检查是
A. 腹部平片
B. X线胃肠钡餐检查
C. 钡剂灌肠造影
D. 结肠镜检查
E. 腹部CT

正确答案：D。结肠镜检查

解析：中年女性患者，反复腹泻病史2年，间有脓血便（黏液脓血便是溃疡性结肠炎活动期表现），粪培养阴性，多种抗生素治疗无效（与细菌性痢疾鉴别），考虑诊断为溃疡性结肠炎。为明确诊断，首选结肠镜检查（D对）。腹部平片（A错）对腹腔内出血、穿孔等有诊断价值，对肠道疾病诊断意义不大。X线胃肠钡餐检查（B错）是消化性溃疡的辅助检查手段。钡剂灌肠造影（C错）是确诊溃疡性结肠炎的次选方法，其价值次于结肠镜。腹部CT（E错）对于消化系统脏器小病灶、等密度病灶、需定位定性的病变以及血管性病变的诊断是必不可少的一种重要检查方法，但是肠道等空腔脏器内部病变诊断不如结肠镜直观，故不作为首选检查方式。